已知受血者为A型血，在交叉配血试验中，主侧不凝集，次侧凝集，给血者血型应该是
A. A型
B. B型
C. O型
D. AB型
E. O型、B型都可能

正确答案：C。O型